具有肝药酶诱导作用的药物有
A. 苯巴比妥
B. 卡马西平
C. 丙戊酸钠
D. 苯妥英钠
E. 乙琥胺

正确答案：A、B、D。苯巴比妥；卡马西平；苯妥英钠

解析：本题考查具有药酶诱导作用的药物。苯巴比妥（A对）、卡马西平（B对）、苯妥英钠（D对）均可诱导肝药酶，加速药物代谢；丙戊酸钠（C错）为肝药酶抑制剂；乙琥胺（E错）对肝药酶无影响。